女性，38岁。左上后牙补牙后咀嚼时疼痛明显7天。无冷、热刺激酸痛，自发痛。口腔检查：左上6原银汞合金补物无折裂、缺损，可见1个亮点。叩诊（-），探诊（-），无松动。温度刺激试验（-）。引起疼痛的原因最可能是
A. 备洞时对牙髓刺激过强
B. 未垫底或垫底材料选择不当
C. 充填物过高，引起牙周性疼痛
D. 接触点恢复不良，形成食物嵌塞
E. 小的穿髓孔未被发现

正确答案：C。充填物过高，引起牙周性疼痛

解析：本题考查充填后疼痛。女性，38岁。左上后牙补牙后咀嚼时疼痛明显7天。无冷、热刺激酸痛，自发痛。口腔检查：左上6原银汞合金补物无折裂、缺损，可见1个亮点。叩诊（-），探诊（-），无松动。温度刺激试验（-）。引起疼痛的原因最可能是充填物过高，引起牙周性疼痛（C对）。患者充填修复后出现咀嚼疼痛，无冷、热刺激酸痛及自发痛，检查时发现银汞合金充填物有亮点，说明充填物存在咬合高点，此种情况引起疼痛的原因最可能是充填物过高，引起牙周性疼痛，确定早接触部位后磨除高点，症状即可消除。备洞时对牙髓刺激过强、未垫底或垫底材料选择不当可引起牙髓激发痛，表现为充填修复后出现冷热刺激痛，但无明显延缓痛或仅有短暂的延缓痛（AB错）。接触点恢复不良，形成食物嵌塞可引起牙周炎，出现持续性自发性疼痛（D错）。小的穿髓孔未被发现，可引起牙髓炎，出现自发痛，温度刺激可诱发或加重疼痛（E错）。